睡前服用，可使抑制肝脏合成胆固醇效果更好的药品是
A. 复方铝酸铋片
B. 二甲双胍片
C. 甲氧氯普胺片
D. 瑞舒伐他汀片
E. 维生素C

正确答案：D。瑞舒伐他汀片

解析：本题考查药品服用的适宜时间。瑞舒伐他汀（D对）睡前服用，因为肝脏合成胆固醇峰期多在夜间，晚餐后服药有助于提高疗效。复方铝酸铋（A错）为胃黏膜保护药，餐前服用可附着于胃壁黏膜。二甲双胍（B错）宜于餐中服用，可减少对胃肠道的刺激和不良反应。甲氧氯普胺（C错）为促胃动力药，餐前服用助消化。维生素C（E错）任何时间服用都可以。